失安全数越大，说明meta分析
A. 各个独立研究的同质性越好
B. 各个独立研究的同质性越差
C. 结果越稳定，结论被推翻的可能性越小
D. 结果越不稳定，结论被推翻的可能性越大
E. 结果可靠性越差

正确答案：C。结果越稳定，结论被推翻的可能性越小

解析：本题考查失安全数的意义。失安全数是指Meta分析中计算需多少阴性研究结果的报告才能使结论逆转，即失安全数来估计发表偏倚的程度。失安全数越大，说明meta分析的结果越稳定，发表偏倚对结果的影响越小，结论被推翻的可能性越小（C对ABDE错）。